碘甘油处方：碘1.0g、碘化钾1.0g、纯化水1ml、甘油加至100ml。关于碘甘油制剂的处方成分作用和应用的说法，错误的是
A. 碘化钾在处方中用作助溶剂，可增加碘的溶解度
B. 碘化钾在处方中可提高碘的稳定性
C. 甘油可缓和碘对黏膜的刺激性
D. 本品临床应用时可加水稀释以降低剌激性
E. 甘油可使药物滞留皮肤或黏膜而延长疗效

正确答案：D。本品临床应用时可加水稀释以降低剌激性

解析：本题考查碘甘油的注解。2.碘甘油【注解】碘在甘油中的溶解度约为1.0%，加入碘化钾与碘形成可溶性络合物而助溶（A对），并可提高碘的稳定性（B对）。甘油作为碘的溶剂可缓和碘对黏膜的刺激性（C对），甘油可使药物滞留皮肤、黏膜而延长疗效（E对）。本品临床应用时不宜用水稀释，以免增加刺激性（D错，为本题正确答案）。